以下关于全冠咬合面的描述哪项是错误的
A. 必须恢复原有的（牙合）面大小与形态
B. 应与邻牙（牙合）面形态相协调
C. 应与对颌（牙合）面形态相协调
D. （牙合）力方向接近牙齿长轴
E. 无早接触

正确答案：A。必须恢复原有的（牙合）面大小与形态

解析：本题考查全冠修复。牙体缺损的修复要正确恢复形态和功能，但是正确恢复形态并不强求恢复牙齿原有的（牙合）面大小与形态（A错，为本题的正确答案），应与牙周条件相适应，以保护基牙和牙周的健康，若基牙条件较差，承受的咬合力又大，则可采取适当措施以减轻基牙的受力，如减少颊舌径以减轻所受（牙合）力，降低高尖陡坡减轻侧向（牙合）力；加深沟槽，以提高咀嚼效能。全冠修复时应恢复正常的邻接关系，与邻牙（牙合）面形态相协调（B对），防止食物嵌塞，且可以使邻牙相互支持。全冠咬合面的恢复应与对颌（牙合）面形态相协调（C对），达到最广泛的尖窝接触，没有早接触（E对）、（牙合）干扰，以提高咀嚼效率。全冠修复时应使（牙合）力方向接近牙齿长轴（D对），与牙周支持能力相协调，才能最大限度的调动牙周潜力，保护基牙健康。